一名男童，性格内向，自4岁起咬指甲，现已8岁仍有遗尿现象，学习成绩一般，近2个月出现口吃。该儿童最可能的问题是
A. 心理卫生问题
B. 有泌尿系统疾病
C. 贫血
D. 神经系统疾病
E. 智力低下

正确答案：A。心理卫生问题

解析：本题考查神经心理发育与行为发展的相关内容。啃咬指甲、遗尿、口吃等表现是儿童时期常见一类心理卫生问题（A对BCDE错）。儿童心理卫生问题的产生与儿童自身神经系统的发育有关及与其生活习惯的培养、生活环境状况等因素有关。